人本主义疗法有以下特点，但应除外
A. 以询者为中心
B. 放松训练
C. 把心理治疗看成一个转变过程
D. 非指令性治疗的技巧
E. 言语操作性条件试验

正确答案：B。放松训练